细菌进入创口几小时内尚未大量繁殖且易于清除
A. 6～12小时内
B. 14小时内
C. 20小时内
D. 24小时内
E. 32小时内

正确答案：A。6～12小时内

解析：本题考查开放性创伤的处理。因伤后6～8小时内清创一般都可达到一期愈合，故细菌进入创口几小时内尚未大量繁殖且易于清除的时间应为6～12小时内（A对）。